钩端螺旋体病的基本病理变化是
A. 全身毛细血管的感染中毒性损伤
B. 小血管及血管周围炎细胞浸润
C. 肺毛细血管出血
D. 急性肾功能不全
E. 弥散性血管内凝血

正确答案：A。全身毛细血管的感染中毒性损伤

解析：钩端螺旋体病的基本病理变化是全身毛细血管的感染中毒性损伤（A对），主要累及全身毛细血管，引起不同程度的循环障碍和出血，以及广泛的实质器官变性、坏死而导致严重功能障碍，但组织形态变化轻微，炎性反应亦轻微，由于菌型和毒力的不同，所引起病变的轻重和主要累及器官的种类也有异，病变严重时可导致肺出血、肾衰竭等。